男，28岁。牙拔除术前作普鲁卡因过敏试验，结果为阳性的局部红晕直径应超过
A. 0.2cm
B. 0.4cm
C. 0.6cm
D. 0.8cm
E. 1.0cm

正确答案：E。1.0cm

解析：本题考查局麻药的过敏试验。男，28岁。牙拔除术前作普鲁卡因过敏试验，结果为阳性的局部红晕直径应超过1.0cm（E对）。普鲁卡因皮内试验，1%普鲁卡因0.1ml稀释至1ml，皮内注射0.1ml，20min后看反应。局部红肿，红晕直径超过1cm者为阳性。